关于标准物质的说法，正确的有
A. 标准品是指采用理化方法鉴别、检查或含量测定时所用的标准物质
B. 标准物质是指用于校准设备、评价测量方法、给供试药品赋值或鉴别药品的物质
C. 标准品与对照品的特性量值均按纯度(%）计
D. 我国国家药品标准物质有标准品、对照品、对照药材、对照提取物和参考品共五类
E. 标准物质具有确定的特性量值

正确答案：B、D、E。标准物质是指用于校准设备、评价测量方法、给供试药品赋值或鉴别药品的物质；我国国家药品标准物质有标准品、对照品、对照药材、对照提取物和参考品共五类；标准物质具有确定的特性量值

解析：本题考查标准物质。关于标准物质的说法，正确的有标准物质是指用于校准设备、评价测量方法、给供试药品赋值或鉴别药品的物质（B对）、我国国家药品标准物质有标准品、对照品、对照药材、对照提取物和参考品共五类（D对）、标准物质具有确定的特性量值（E对）。标准物质系指供药品检验（鉴别、检查、含量或效价测定）中使用的，具有确定特性量值，用于校准设备、评价测量方法、给供试药品赋值或者鉴别用的物质。国家药品标准物质共有五类：标准品、对照品、对照药材、对照提取物、参考品，均应按其标签或使用说明书的规定使用和贮藏。其中，供化学药物与抗生素测定用的标准物质为对照品与标准品。对照品系指采用理化方法进行鉴别、检查或含量测定时所用的标准物质，其特性量值一般按纯度（%）计（C错）。例如，紫外-可见分光光度法测定药物含量时使用对照品作为标准物质；标准品系指用于生物检定或效价测定的标准物质（A错），其特性量值按效价单位（U）或重量单位（㎍）计，以国际标准物质进行标定，供试品的效价以标准品的效价单位赋值。例如，硫酸庆大霉素的含量限度，《中国药典》规定：按无水物计算，每1mg的效价不得少于590庆大霉素单位（1000庆大霉素单位相当于1mg庆大霉素）。